明目上清片的主治是
A. 肝胃火盛所致的目赤肿痛、眼缘溃烂、畏光怕风、眼角涩痒
B. 肝肾两亏、阴虚火旺所致的内障目暗、视物昏花
C. 肝火旺盛所致的目赤肿痛、视物昏暗、羞明流泪、胬肉攀睛
D. 上焦火盛引起的暴发火眼、云蒙障翳、羞明多眵、眼边赤烂、红肿痛痒、迎风流泪
E. 外感风热所致的暴发火眼、红肿作痛、头晕目眩、眼边刺痒、大便燥结、小便赤黄

正确答案：E。外感风热所致的暴发火眼、红肿作痛、头晕目眩、眼边刺痒、大便燥结、小便赤黄

解析：本题考查的是明目上清片的主治。明目上清片的主治是外感风热所致的暴发火眼、红肿作痛、头晕目眩、眼边刺痒、大便燥结、小便赤黄（E对）。明目上清片：【主治】外感风热所致的暴发火眼、红肿作痛、头晕目眩、眼边刺痒、大便燥结、小便赤黄。八宝眼药散：【主治】肝胃火盛所致的目赤肿痛、眼缘溃烂、畏光怕风、眼角涩痒（A错）。石斛夜光颗粒：【主治】肝肾两亏、阴虚火旺所致的内障目暗，视物昏花（B错）。黄连羊肝丸：【主治】肝火旺盛所致的目赤肿痛，视物昏暗，羞明流泪，胬肉攀睛（C错）。明目蒺藜丸：【主治】上焦火盛引起的暴发火眼、云蒙障翳、羞明多眵、眼边赤烂、红肿痛痒、迎风流泪（D错）。